马钱子的主要有效成分属于
A. 莨菪烷类生物碱
B. 甾体生物碱
C. 萜类生物碱
D. 有机胺类生物碱
E. 吲哚类生物碱

正确答案：E。吲哚类生物碱

解析：本题考查的是马钱子中主要生物碱的化学结构。马钱子的主要有效成分属于吲哚类生物碱（E对）。马钱子成熟种子中生物碱含量为1.5%～5%，主要生物碱是士的宁（又称番木鳖碱）、马钱子碱及其氮氧化物，还含少量的10余种其他吲哚类生物碱，其中以士的宁含量居首，占总碱量的35%～50%，其次是马钱子碱，占总碱量的30%～40%。《中国药典》以士的宁和马钱子碱为指标成分进行含量测定，要求士的宁的含量应为1.20%～2.20%，马钱子碱的含量不得少于0.80%。莨菪烷类生物碱（A错）：多来源于鸟氨酸，由莨菪烷环系的C₃-醇羟基与有机酸缩合成酯。主要存在于茄科的颠茄属、曼陀罗属、莨菪属和天仙子属。重要化合物有莨菪碱、古柯碱等。萜类生物碱（C错）存在于川乌中。川乌中主要毒性生物碱及其化学结构：乌头和附子主要含二萜类生物碱，属于四环或五环二萜类衍生物。乌头生物碱的结构复杂、结构类型多。其重要和含量较高的有乌头碱、次乌头碱和新乌头碱。《中国药典》以三者为指标成分进行含量测定，要求三者总量应为0.050～0.17%。有机胺类生物碱（D错）：结构特点是氮原子不在环状结构内，如麻黄中的麻黄碱，秋水仙中的秋水仙碱，益母草中的益母草碱等。含甾体生物碱（B错）的中药，2022年考试指南未明确说明。